黄芪的主治病症是
A. 阴虚燥咳
B. 表虚自汗
C. 胃痰呕吐
D. 湿热泻痢
E. 风寒湿痹

正确答案：B。表虚自汗

解析：黄芪性味甘，微温。归脾、肺经，能补肺脾之气，益卫固表以止汗，治脾肺气虚所致卫气不固，表虚自汗者（B对）。